克林霉素
A. 具有较强抗绿脓杆菌作用
B. 主要用于金葡菌引起的骨及关节感染
C. 为支原体肺炎首选药物
D. 具有抗DNA病毒的作用
E. 对念珠菌有强大抗菌作用

正确答案：B。主要用于金葡菌引起的骨及关节感染

解析：克林霉素在体内分布较广，在骨组织中的浓度是血药浓度的1.5倍，故该药物可用于金黄色葡萄球菌所致的急慢性骨髓炎和脓性关节炎的治疗（B对）。哌拉西林（P372）具有较强抗绿脓杆菌作用（A错）。大环内酯类如红霉素、阿奇霉素（P378）为支原体肺炎首选药物（C错）。利巴韦林（P406）具有抗DNA病毒的作用（D错）。两性霉素B（P414）对念珠菌有强大抗菌作用（E错）。